中医学称小儿为“纯阳之体”，其含义是
A. 纯阳无阴
B. 发育迅速
C. 阳常有余
D. 肝常有余
E. 阴虚阳亢

正确答案：B。发育迅速

解析：《颅囟经·脉法》说：“凡孩子3岁以下，呼为纯阳，元气未散”。所谓“纯”，指小儿未经情欲克伐、胎元之气尚未耗散；所谓“阳”，即以阳为用。“纯阳”是说明小儿生机蓬勃，发育迅速，好比旭日之初生，草木之方萌，蒸蒸日上、欣欣向荣的蓬勃景象（B对）。纯阳无阴（A错），指阳气偏亢、阴气耗竭，为危重证候。朱丹溪认为饮食失节，嗜酒纵欲，伤伐过度，则阳热易亢，虚火妄动，故阳常有余（C错），为病理特点。肝常有余（D错）是对小儿易动肝风的病理特点的概括。阴虚阳亢（E错），为病机特点，正常情况下，阴阳相互平衡，若阴不足而造成的阳相对偏亢，就称为阴虚阳亢。